对本机构药师经考核合格后取得
A. 麻醉药品的处方权
B. 第一类精神药品的处方权
C. 第一类精神药品调剂资格
D. 执业药师证书
E. 以上说法均正确

正确答案：C。第一类精神药品调剂资格

解析：医疗机构应当按照有关规定，对本机构执业医师和药师进行麻醉药品和精神药品使用知识和规范化管理的培训。执业医师经考核合格后取得麻醉药品和第一类精神药品的处方权，药师经考核合格后取得麻醉药品和第一类精神药品调剂资格。掌握“处方管理概述及一般规定、处方权”知识点。